导致消化性溃疡的主要因素之一是
A. 大肠杆菌
B. 胰岛素分泌不足
C. 幽门螺杆菌
D. 消化道痉挛
E. 白色念珠菌

正确答案：C。幽门螺杆菌

解析：本题考查消化性胃溃疡。导致消化性溃疡的主要因素之一是幽门螺杆菌（C对）。消化性溃疡的发病机制分为三个方面：（1）胃酸在溃疡形成中起到关键作用。（2）幽门螺杆菌（HP）感染。（3）黏膜屏障的完整性受到破坏，以药物性溃疡和应激性溃疡为代表。大肠杆菌（A错）感染可导致轻度急性腹泻、结膜炎等。胰岛素分泌不足（B错）会导致糖尿病。消化道痉挛（D错）会导致便秘。白色念珠菌（E错）会诱发真菌性阴道炎。